疾病的发生、发展和转归取决于
A. 发病的时间
B. 病邪的性质
C. 正气的强弱
D. 病变的部位
E. 治疗的方法

正确答案：C。正气的强弱

解析：正邪盛衰消长的变化是虚、实两类证候的病理基础，不仅直接关系着疾病的发生，而且影响并决定着疾病的发展、转归及预后(C对)。环境因素，主要包括地理环境和时令气候，两者之间密切相关，并共同作用千人体，对疾病的传变发生影响，但不能对疾病的变化起决定性作用（A错）病邪是影响疾病传变的重要因素，病位、病性传变以及疾病传变速度等，都受到感邪轻重、病邪性质等的影响（BD错）。在疾病的发生发展过程中，诊治因素是疾病传变中较为关键的因素，是否做到早期诊治，可以直接关系到疾病的传变与转归，但是疾病的发生与发展没有取决作用（E错）。